毛果芸香碱（匹鲁卡品）对眼的作用表现为
A. 降低眼压、扩瞳、调节痉挛
B. 降低眼压、缩瞳、调节麻痹
C. 降低眼压、缩瞳、调节痉挛
D. 升高眼压、扩瞳、调节痉挛
E. 升高眼压、缩瞳、调节痉挛

正确答案：C。降低眼压、缩瞳、调节痉挛